长期慢性出血，导致气血不足的脉象是
A. 浮大无根，按之消失
B. 举之有余，按之不足
C. 浮大中空
D. 浮而弦硬
E. 浮而细软

正确答案：E。浮而细软

解析：长期慢性出血，导致气血不足，出现的脉象应为虚象之脉，浮而细软为濡脉之脉象，主虚证（E对）。“浮大无根，按之消失”为元气离散、脏气将绝之脉，与题干不符（A错）。“举之有余，按之不足”为浮脉之相，主表证，与题干不符（B错）。“浮大中空”为芤脉脉象特征，主失血伤阴，与题干不符（C错）。